可作为气雾剂抗氧剂的是
A. 乙醇
B. 七氟丙烷
C. 聚山梨酯
D. 维生素C
E. 液状石蜡

正确答案：D。维生素C

解析：本题考查气雾剂的附加剂。维生素C（D对）可作为气雾剂的抗氧化剂；乙醇（A错）为潜溶剂；七氟丙烷（B错）为抛射剂；聚山梨酯（C错）为表面活性剂；液体石蜡（E错）可作为乳膏剂等的油相基质。